糖尿病酮症酸中毒
A. AG增高性代谢性酸中毒
B. AG正常性代谢性酸中毒
C. 两者均有
D. 两者均无
E. 无

正确答案：A。AG增高性代谢性酸中毒

解析：AG增高型代谢性酸中毒（A对）其特点是AG增高，血氯正常。发生糖尿病酮症酸中毒，血浆内酮体含量上升，其中H+被HC03-缓冲，其酸根（β-羟丁酸根、乙酰乙酸根）增高。这部分酸根均属没有测定的阴离子，所以AG值增大，而Cl-值正常，故又称正常血氯代谢性酸中毒。